下列哪一种是测定生物体内代谢的样本
A. 全血
B. 尿液
C. 唾液
D. 肌肉
E. 脂肪

正确答案：B。尿液

解析：本题考查体内药物检测。尿液（B对）是测定生物体内代谢的样本。体内药物的代谢主要是通过肾脏，药物的代谢产物存在于尿液中。血液（A错）中的药物浓度与靶器官中药物浓度相关性最大。唾液（C错）不一定与药物浓度有相关性，取决于药物使用部位和使用方法。肌肉（D错）、脂肪（E错）等活体组织一般用于药物临床前动物体内组织分布研究。